营气的分布是
A. 贯注心肺
B. 行于脉外
C. 行于脉中
D. 下注气街
E. 上出气道

正确答案：C。行于脉中

解析：营气由水谷之精所化生，进入脉中，循脉运行全身，内入脏腑，外达肢节，终而复始，营周不休（C对）。宗气聚于胸中，通过上出息道（E错），贯注心脉（A错）及沿三焦下行下注气街（D错）的方式布散全身。卫气由水谷之精化生，运行于脉外（B错），不受脉道的约束，外而皮肤肌腠，内而胸腹脏腑，布散全身。